依靠被测气体分子的扩散进行空气样品采集的方法是
A. 主动采集
B. 被动采集
C. 集气法
D. 个体采样
E. 定点区域采样

正确答案：B。被动采集